可防止高血压患者血管壁的增厚和心肌细胞增生肥大的降压药是
A. 氢氯噻嗪
B. 卡托普利
C. 硝苯地平
D. 普萘洛尔
E. 哌唑嗉

正确答案：B。卡托普利

解析：卡托普利（B对）属于血管紧张素转化酶抑制剂，具有轻、中等强度的降压作用，起效快，对正常血压也有降压作用，长期应用尚能减轻或逆转高血压所致的心血管壁增厚和心肌肥厚，保护靶器官。氢氯噻嗪（A错）属于中毒利尿药，降压作用温和、缓慢、持久、对卧、立位血压均有降低作用，单用用于治疗轻、中度高血压，尤其适用于伴有心力衰竭的高血压患者。硝苯地平（C错）属于二氢吡啶类钙拮抗药，对血管有较高的选择性，引起小动脉平滑肌松弛，动脉血管扩张，外周阻力下降，血压降低。普萘洛尔（D错）具有中等程度的降压作用，口服作用缓慢，给药2-3周才出现降压作用，降压作用持久，长期不引起体位性低血压、耐受性以及水钠潴留。哌唑嗪（E错）可选择性阻断α₁受体，使小动脉和小静脉血管扩张，从而降低外周阻力，血压下降，降压时不引起心率加快与肾素分泌，长时间有降血脂作用，对糖代谢无影响。